下列哪种研究，最适宜少见病的病因分析
A. 现况研究
B. 病例对照研究
C. 队列研究
D. 实验性研究

正确答案：B。病例对照研究

解析：本题考查病例对照研究的优点。病例对照研究（B对ACD错）特别适合于罕见病、潜伏期长疾病的病因研究，有时往往是罕见病病因研究的唯一选择。